元神之府指的是
A. 心
B. 肾
C. 脑
D. 头
E. 肝

正确答案：C。脑

解析：脑，又名髓海，深藏于头部，居颅腔之中，其外为头面，内为脑髓，是精髓和神明汇集 发出之处，又称为元神之府（C对）。心为藏神之脏，君主之官，生之本，五脏六腑之大主（A错）。肾有先天之本，封藏之本，五脏阴阳之本之称（B错）。头为精明之府（D错）。肝为将军之官，谋虑出焉（E错）。